肾蒂内不包括
A. 肾动脉
B. 肾静脉
C. 肾窦
D. 肾盂
E. 神经

正确答案：C。肾窦

解析：肾蒂为结缔组织包裹的出入肾门诸结构，包括肾的血管（AB对）、神经（E对）、淋巴管及肾盂（D对）等，肾窦（C错，为本题正确答案）为肾门伸入肾实质的腔隙，不在肾蒂中。